在循证药物信息中缺乏证据支持的药物信息是
A. A类信息
B. E类信息
C. C类信息
D. B类信息
E. D类信息

正确答案：C。C类信息